乳牙（牙合）期间特征不包括
A. 无明显倾斜
B. 曲线不明显
C. 平齐末端
D. 牙列拥挤
E. 深覆（牙合）

正确答案：D。牙列拥挤

解析：完整的乳牙（牙合）约在2岁半时建成，并形成稳定的乳牙（牙合）关系。从2岁半至6岁左右第一颗恒牙萌出之前，皆属乳牙（牙合）时期。①2.5～4岁期间的特征：牙排列紧密而无明显间隙；切缘及（牙合）面尚无显著磨耗；乳牙位置较正，没有明显的近远中向或唇（颊）舌向倾斜；覆（牙合）较深，覆盖较小，（牙合）曲线不明显；上、下颌第二乳磨牙的远中面彼此相齐，成一垂直平面称为齐平末端。②4～6岁期间的特征：随着颌骨的长大，牙排列不紧密，前牙间隙逐渐形成；牙的切缘及（牙合）面产生显著磨耗；下颌第二乳磨牙移至上颌第二乳磨牙的稍前方（近中）；随着下颌升支发育，暂时性深覆（牙合）减小。掌握“（牙合）的生长发育”知识点。